根据《中医药法》，关于医疗机构中药饮片管理的说法，正确的是
A. 根据临床需要，可以凭本医疗机构医师处方采用中药材代替中药饮片调剂使用
B. 对市场供应不足的中药饮片，可以在本医疗机构内炮制使用
C. 医疗机构对其炮制的中药饮片质量负责
D. 炮制中药饮片，应当向所在地县级药品监督管理部门备案

正确答案：C。医疗机构对其炮制的中药饮片质量负责

解析：本题考查医疗机构中药饮片管理。根据《中医药法》，关于医疗机构中药饮片管理的说法，正确的是医疗机构对其炮制的中药饮片质量负责（C对）。《中医药法》第二十八条规定，对市场上没有供应的中药饮片，医疗机构可以根据本医疗机构医师处方的需要，在本医疗机构内炮制、使用（B错）。医疗机构应当遵守中药饮片炮制的有关规定，对其炮制的中药饮片的质量负责，保证药品安全。医疗机构炮制中药饮片，应当向所在地设区的市级人民政府药品监督管理部门备案（D错）。根据临床用药需要，医疗机构可以凭本医疗机构医师的处方对中药饮片进行再加工（A错）。